氯丙嗪引起的低血压、休克抢救时禁用肾上腺素是因为氯丙嗪
A. 可阻断M受体
B. 可阻断β受体
C. 可阻断α受体
D. 直接扩张血管平滑肌
E. 有抑制血管运动中枢作用

正确答案：C。可阻断α受体

解析：本题考查氯丙嗪的药理作用及机制。氯丙嗪引起的低血压、休克抢救时禁用肾上腺素是因为氯丙嗪可阻断α受体（C对），产生耐受性。氯丙嗪拮抗M胆碱受体作用较弱，可引起口干、便秘、视力模糊（A错）。氯丙嗪不可阻断β受体（B错）、不能直接扩张血管平滑肌（C错）、无有抑制血管运动中枢作用（E错）。